胸部触诊语音震颤减弱的是
A. 肺脓肿
B. 肺梗死
C. 阻塞性肺气肿
D. 空洞型肺结核
E. 大叶性肺炎

正确答案：C。阻塞性肺气肿

解析：本题考查慢性阻塞性肺疾病。阻塞性肺气肿（C对）：桶状胸、语音震颤减弱、叩诊呈过清音、两肺呼吸音减弱，呼气延长。